小儿阑尾炎的特点正确的是
A. 可保守治疗
B. 穿孔率高
C. 右下腹压痛，肌紧张症状典型
D. 不发热、症状不明显
E. 死亡率较低

正确答案：B。穿孔率高

解析：小儿发生急性阑尾炎的原因多为小儿大网膜发育不全，不能起到足够的保护作用，可出现高热、呕吐等症状（D错）；右下腹体征不明显，没有典型的右下腹压痛和肌紧张等症状（C错）；小儿患病后，穿孔率较高（B对），并发症和死亡率也较高（E错）；早期手术、输液、广谱抗生素治疗是其治疗原则，一般不选择保守治疗（A错）。